下列对社会病的特点描述不正确的是
A. 社会病的产生根源非常复杂
B. 社会病对社会具有严重的危害性
C. 社会病不一定有社会性
D. 社会病的防治需要全社会综合施策、共同努力
E. 社会病也是公共卫生问题

正确答案：C。社会病不一定有社会性

解析：本题考查社会病的特点。社会病的产生根源非常复杂（A对）；社会病对社会具有严重的危害性（B对）；社会病具有社会性（C错，为本题正确答案）；社会病的防治需要全社会综合施策、共同努力（D对）；社会病也是公共卫生问题（E对）。